通过抑制A型单胺氧化酶，减少去甲肾上腺素、5-HT及多巴胺的降解，增强去甲肾上腺素、5-HT和多巴胺能神经功能，发挥抗抑郁作用的药物是
A. 舍曲林
B. 阿米替林
C. 吗氯贝胺
D. 度洛西汀
E. 曲唑酮

正确答案：C。吗氯贝胺

解析：本题考查舍曲林。吗氯贝胺（C对）为单胺氧化酶抑制剂，作用机制为抑制A型单胺氧化酶，减少去甲肾上腺素、5-HT及多巴胺的降解，增强去甲肾上腺素、5-HT和多巴胺能神经功能，发挥抗抑郁作用。舍曲林（A错）为选择性5-羟色胺再摄取抑制剂，通过选择性抑制5-HT再摄取，增加突触间隙5-HT浓度，从而增强5-HT能神经功能而发挥抗抑郁作用。阿米替林（B错）为三环类抗抑郁药，作用机制为抑制突触前膜对5-HT及去甲肾上腺素的再摄取，使突触间隙的去甲肾上腺素和5-HT浓度升高，促进突触传递功能而发挥抗抑郁作用。文拉法辛、度洛西汀（D错）为5-HT和去甲肾上腺素（NA）再摄取抑制剂，作用机制为抑制5-HT和去甲肾上腺素(NA）再摄取，增加突触间隙5-HT和NA浓度从而增强中枢5-HT和NA能神经功能而发挥抗抑郁作用。曲唑酮（E错）为5-HT受体阻断剂/再摄取抑制剂，作用机制为抑制突触前膜对5-HT的再摄取，并拮抗5-HT₁受体，也能拮抗中枢α₁受体，但不影响中枢多巴胺的再摄取。同时曲唑酮虽不抑制外周去甲肾上腺素的再摄取，但通过拮抗突触前膜α₂受体增加去甲肾上腺素的释放，进而发挥抗抑郁作用。